衡量心力衰竭的指标是
A. 心泵功能改变
B. 心肌舒张功能障碍
C. 心肌收缩功能障碍
D. 回心血量不足
E. 心输出量不能满足机体代谢需要

正确答案：E。心输出量不能满足机体代谢需要

解析：心力衰竭是指各种原因引起心脏结构和功能（BC错）的改变，使心室泵血量（A错）和（或）充盈功能低下，以至不能满足机体代谢需要（E对）的病理生理过程，因而衡量患者有无心衰的指标是心输出量是否满足机体代谢需要。